流行病学的基本研究方法是
A. 观察法、求同法、数理法
B. 观察法、实验法、数理法
C. 求异法、实验法、数理法
D. 剩余法、观察法、数理法
E. 共变法、观察法、类比法

正确答案：B。观察法、实验法、数理法

解析：本题考查流行病学的基本研究方法。流行病学的基本研究方法包括观察法、实验法和数理法（B对ACDE错）。